下列疾病中可以见到酶原颗粒的是
A. 腺泡细胞癌
B. 腺样囊性癌
C. 基底细胞癌
D. 多形性腺癌
E. 透明细胞癌

正确答案：A。腺泡细胞癌

解析：本题考查唾液腺上皮性恶性肿瘤。下列疾病中可以见到酶原颗粒的是腺泡细胞癌（A对）。腺泡细胞癌是唾液腺恶性上皮性肿瘤，构成肿瘤的细胞中至少部分肿瘤细胞含有酶原颗粒，呈浆液性腺泡细胞分化。肿瘤中可含闰管细胞。腺样囊性癌（B对）是一种基底细胞样肿瘤，它由上皮细胞和肌上皮细胞排列成管状、筛状和实性巢等不同的形态结构。尽管生长缓慢，但是由于浸润性生长，常危及患者生命。又称为圆柱瘤。基底细胞癌（C错）开始是一个皮肤色到暗褐色浸润的小结节，较典型者为蜡样、半透明状结节，有高起卷曲的边缘。中央开始破溃，结黑色坏死性痂，中心坏死向深部组织扩展蔓延，呈大片状侵袭性坏死，可以深达软组织和骨组织。多形性腺癌（D错）是以细胞形态的一致性、组织结构的多样性和浸润性生长为特征的唾液腺上皮性恶性肿瘤。又称为多形性低度恶性腺癌，终末导管癌，小叶癌，舌或小唾液腺筛状腺癌。透明细胞癌 （E错）是由一群形态单一、HE染色胞质透明的细胞构成的低度恶性唾液腺上皮性恶性肿瘤，伴有或不伴有玻璃样变性。具有鳞状细胞样表型，由于许多类型唾液腺肿瘤常含透明细胞成分，透明细胞癌同这些肿瘤的区别是其透明细胞形态单一，且缺乏其他肿瘤的特征性结构。又称为玻璃样透明细胞癌。